对中心静脉压正常，血压下降的病人的正确的处理是
A. 充分补液
B. 适当补液
C. 强心
D. 扩张血管
E. 进行补液试验后处理

正确答案：E。进行补液试验后处理

解析：中心静脉压代表了右心房或者胸腔段腔静脉内压力的变化，可反映心功能和全身血容量之间的关系。当中心静脉压正常但血压下降时，有两种可能的原因：一种是心功能不全造成，右心功能尚可维持正常的中心静脉压，而左心射血功能下降，射血减少导致外周血压下降；二是血容量不足，直接导致外周血压下降，但心功能正常，维持正常的中心静脉压。此时需要先进行补液试验（E对）后处理，即在5～10分钟内向静脉注射等渗盐水250ml，如果血压升高而中心静脉压不变，提示血容量不足，应补液治疗；如果血压不变而中心静脉压升高，提示心功能不足，应强心治疗。充分补液适用于中心静脉压低、血压下降的病人，即严重血容量不足（A错）。适当补液适用于中心静脉压低、血压正常的患者，此类患者为相对血容量不足（B错）。强心治疗适用于中心静脉压高、血压下降的患者，此类患者为心功能不全，不能将回流到右心的血液射出去（C错）。扩张血管适用于中心静脉压高、血压正常的患者，此类患者是由于容量血管过度收缩，造成回流血量相对增加而加重了右心负担（D错）。